男，31岁。曾诊断为颅内动脉瘤破裂出血，3天后，剧烈头痛意识朦胧躁动频繁呕吐，查体可见视乳头水肿。可能的判断是
A. 再次出血
B. 术后感染
C. 术后并发症
D. 脑梗塞
E. 脑积水

正确答案：A。再次出血

解析：青年男性患者，近期有颅内动脉瘤破裂出血史（提示存在蛛网膜下腔出血并发症可能），3天后出现颅内压增高症状和体征（剧烈头痛意识朦胧躁动频繁呕吐，查体可见视乳头水肿）。根据病史及临床表现及体检，考虑再次出血（A对）可能性大。颅内动脉瘤破裂可引起蛛网膜下腔出血，其常见并发症有再次出血、脑血管痉挛和急性或亚急性脑积水，其中再次出血最常见。脑积水时（E错）可见于SAH出血后血凝块阻碍脑脊液循环及蛛网膜黏连，表现为颅内压增高，但多发展较慢，症状不如再出血严重。患者未进行手术治疗，故术后感染（B错）及术后并发症（C错）不考虑诊断。脑梗塞（D错）患者多有偏瘫、失语等局灶性神经功能缺损，既往有栓子来源的基础疾病（P185）。